为了评价实施改换水源降低水氟工程后的效果，在全国饮水型地方性氟中毒流行严重的10省市，采用整群抽样调查的方法，共调查1758个改换水源的工程，约占全部改水工程的97％，选择1980年实施改换水源降氟工程后，在当地出生并饮用该水8年及以上的8～12岁儿童，调查其氟斑牙患病情况，该研究属于
A. 队列研究
B. 病例对照研究
C. 临床试验
D. 社区干预试验
E. 生态学研究

正确答案：E。生态学研究